患者，38岁。女性，主诉右侧牙齿自发性剧烈疼痛3天。疼痛呈放散性，夜间痛。检查见右侧牙齿未见牙体病损，但右上第一磨牙颊侧近中探及深达根尖部的牙周袋。冷（++），松动Ⅰ度，叩诊（+）。可能的诊断为
A. 急性牙髓炎
B. 急性牙龈炎
C. 逆行性牙髓炎
D. 急性根尖周炎
E. 残髓炎

正确答案：C。逆行性牙髓炎

解析：检查见右侧牙齿未见牙体病损且右上第一磨牙颊侧近中探及深达根尖部的牙周袋，是牙周来源的疾病，表现为急性牙髓炎的症状，可诊断为逆行性牙髓炎。掌握“残髓炎及逆行性牙髓炎”知识点。